男，60岁。发现皮肤黄染，尿色变深伴皮肤瘙痒两周。查体：皮肤巩膜黄染，右上腹可触及无痛性圆形肿块，随呼吸上下活动。该肿块可能是
A. 胆总管囊肿
B. 肝脏囊肿
C. 肿大胆囊
D. 胰头癌
E. 胆管癌

正确答案：C。肿大胆囊

解析：患者老年男性，皮肤、巩膜黄染、尿色变深、皮肤瘙痒两周，右上腹可触及无痛性圆形肿块，应首先考虑壶腹癌或胆总管中、下段癌，故右上腹触及的肿块可能是肿大胆囊（C对）。胆总管囊肿（A错）一般指小儿先天性胆管扩张症，是一种先天性疾病，多见于儿童。肝脏囊肿（B错）、胰头癌（D错）、胆管癌（E错）均可压迫胆管引起黄疸，但均不能从体表触及。